单纯的刷牙能平均清除菌斑的
A. 40%左右
B. 50%左右
C. 60%左右
D. 70%左右
E. 80%左右

正确答案：B。50%左右

解析：本题考查菌斑控制的方法-刷牙。单纯的刷牙能平均清除菌斑的50%左右（B对）。单纯的刷牙平均只能清除菌斑的50%左右。刷牙被普遍认为是维护口腔卫生、机械性去除菌斑和软垢最常用、最有效的方法。刷牙适用于所有人群。刷牙是自我口腔保健的主要手段，使用设计合理的牙刷和科学的刷牙方法能有效地清除菌斑，通常建议每天早晚刷牙，也可午餐后增加一次。但与刷牙次数相比，更应强调刷牙的效果。但一般的刷牙方法只能清除颊舌面及咬合面的菌斑，占菌斑的40%～60%左右；在牙齿的邻面常余留菌斑；对于因牙周疾病而使牙间隙增宽、牙列不齐或带有各种固定装置或矫治器等时，除刷牙外，还须辅以其他工具和方法如牙线、间隙刷、牙签、冲洗器等，才能彻底清除菌斑。